可能引起心悸、心绞痛发作的药物
A. 碘，碘化物
B. 丙硫氧嘧啶
C. 左甲状腺素
D. 鲨肝醇
E. 左炔诺孕酮

正确答案：C。左甲状腺素

解析：本题考查药物的不良反应。甲状腺激素（C对）会引起心动过速、心悸、心绞痛、心律失常、暂时性低血压；月经紊乱；体重减轻、骨骼肌痉挛、肌无力。丙硫氧嘧啶（B错）不良反应：（1）十分常见药物过敏：皮肤瘙痒、皮疹、药物热、红斑狼疮样综合征（表现为发热、畏寒、全身不适、软弱无力）、剥脱性皮炎、白细胞计数减少、轻度粒细胞计数减少。（2）常见关节痛、白细胞和粒细胞计数减少、中性粒细胞胞浆抗体相关性血管炎、脉管炎。左炔诺孕酮（E错）可能增加血栓形成风险。左炔诺孕酮属于避孕药，使用时应警惕避孕药促进血栓的形成，特别是肥胖的抽烟女性应谨慎选择口服避孕药。